可能有心功能不全存在的是
A. 中心静脉压很低，尿量多
B. 中心静脉压偏低，尿量少
C. 中心静脉压偏低，尿量多
D. 中心静脉压偏高，尿量多
E. 中心静脉压很高，尿量少

正确答案：E。中心静脉压很高，尿量少

解析：中心静脉压（CVP）：CVP的正常值为5～10cmH2O。在低血压情况下，CVP低于5cmH2O时，表示血容量不足，高于15cmH2O时，提示心功能不全、静脉血管床过度收缩或肺循环阻力增加；高于20cmH2O时，则表示有充血性心力衰竭。掌握“休克”知识点。